属类固醇激素的是
A. 促肾上腺皮质激素
B. 肾上腺皮质激素
C. 肾上腺髓质激素
D. 促甲状腺激素
E. 甲状腺激素

正确答案：B。肾上腺皮质激素

解析：肾上腺皮质激素包括皮质醇和醛固酮等属于类固醇类激素（B对）：促肾上腺皮质激素（ACTH）属于肽类激素（A错）。肾上腺髓质激素属于胺类激素（C错）。促甲状腺激素（TSH）属于蛋白质类激素（D错）。甲状腺激素属于胺类激素（E错）。